关于栓剂基质聚乙二醇的叙述，错误的是
A. 聚合度不同，其物理性状也不同
B. 遇体温不熔化但能缓缓溶于体液中
C. 为水溶性基质，仅能释放水溶性药物
D. 不能与水杨酸类药物配伍
E. 为避免对直肠黏膜的刺激，可加入约20%的水

正确答案：C。为水溶性基质，仅能释放水溶性药物

解析：本题考查栓剂的基质。聚乙二醇为水溶性栓剂基质，可以用于水溶性或者难溶性药物的载体（C错，为本题正确答案）；聚乙二醇的聚合度不同，物理性状也不同（A对）；聚乙二醇熔点高于体温，因此遇体温不熔化，但是聚乙二醇具水溶性，能缓缓溶于体液（B对）；不能配伍使用水杨酸（D对）；聚乙二醇吸湿性强，加入约20%的水后能降低吸湿性，避免对直肠黏膜的刺激（E对）。